DNA分子中所含的碱基是
A. GCTU
B. GACT
C. AGCU
D. GATU
E. TCAU

正确答案：B。GACT

解析：GCTU（A错）、 AGCU（C错）、GATU（D错）及TCAU（E错）中的U碱基是RNA分子中所含有的碱基，GACT（B对）才是DNA分子中所含有的碱基。